下列关于脑梗死急性期药物治疗的说法，正确的是
A. 急性脑梗死的溶栓治疗时间窗是48小时内
B. 血小板计数<100×10⁹/L时应禁用溶栓药
C. 甘油果糖脱水作用较甘露醇强且快
D. 应在使用溶栓药的同时联合使用阿司匹林
E. 应在使用溶栓药的同时联合使用抗凝药

正确答案：B。血小板计数<100×10⁹/L时应禁用溶栓药

解析：本题考查脑梗死急性期药物治疗。脑梗死又称缺血性脑卒中，当血小板计数（B对）＜100×10⁹/L，血糖＜2.7mmol/L，收缩压＞180mmHg，或舒张压＞100mmHg，妊娠时，禁用溶栓药。急性脑缺血卒中溶栓治疗窗时间非常短暂，为3h（A错）。甘油果糖脱水比用甘露醇剂量更小，脱水作用更温和（C错）。使用溶栓药24h后再开始使用阿司匹林（D错）。溶栓后24h内不建议使用抗凝药（E错）。